抗肿瘤药氟他胺的不良反应包括
A. 男性乳房发育、乳房触痛
B. 恶心、呕吐
C. 骨髓抑制
D. 肝功能损害
E. 失眠、疲倦

正确答案：A、B、E。男性乳房发育、乳房触痛；恶心、呕吐；失眠、疲倦

解析：本题考查氟他胺的不良反应。男性乳房发育、乳房触痛（A对）；恶心、呕吐（B对）；失眠、疲倦（E对）为抗肿瘤药氟他胺的不良反应。氟他胺为抗雄激素类药，不良反应是因治疗过程中雄激素作用减少所致，减少剂量或停药后症状消失。